小肠者
A. 仓廪之官，五味出焉
B. 中正之官，决断出焉
C. 受盛之官，化物出焉
D. 相傅之官，治节出焉
E. 作强之官，伎巧出焉

正确答案：C。受盛之官，化物出焉

解析：《黄帝内经·灵兰秘典论》：“小肠者，受盛之官，化物出焉（C对）…脾胃者，仓廪之官，五味出焉（A错）…胆者，中正之官，决断出焉（B错）…肺者，相傅之官，治节出焉（D错）…肾者，作强之官，伎巧出焉（E错）”